有先兆偏头痛最常见的先兆是
A. 运动先兆
B. 听觉先兆
C. 视觉先兆
D. 言语先兆
E. 感觉先兆

正确答案：C。视觉先兆

解析：偏头疼可分为无先兆偏头疼及有先兆偏头疼。有先兆偏头约占偏头痛患者的 10%，听觉先兆、视觉先兆、言语先兆、感觉先兆、运动先兆均可出现，但最常见的为视觉先兆（C对）。